阿托品对胆碱受体的作用是
A. 对M、N胆碱受体有同样阻断作用
B. 对N1、N2胆碱受体有同样阻断作用
C. 对M胆碱受体具有高度选择性的阻断作用，大剂量也阻断N胆碱受体
D. 对M胆碱受体具有高度选择性的阻断作用，大剂量也阻断N2胆碱受体
E. 对M胆碱受体具有高度选择性的阻断作用，对N胆碱受体无影响

正确答案：C。对M胆碱受体具有高度选择性的阻断作用，大剂量也阻断N胆碱受体

解析：阿托品属于选择性M受体阻断剂，能够选择性阻断M受体（AB错），作用广泛，小剂量能够抑制腺体分泌，引起口干和皮肤干燥，临床用于麻醉前给药，防止分泌物阻塞气道引起窒息或吸入性肺炎。阿托品还能作用于眼，具有扩瞳、升高眼内压和调节麻痹的作用，临床用于检查眼底以及虹膜睫状肌炎，较大剂量的阿托品能够兴奋心脏，引起心率加快，解除外周以及内脏小血管的痉挛，改善微循环，增加组织的血流灌注量，临床可用于缓慢型心律失常，中毒性痢疾、中毒性肺炎等所致的感染性休克，大剂量还能阻断N受体（C对DE错）。